某化工厂的清釜工，在体检时发现1例肝血管肉瘤癌，该工人最可能接触了
A. 氯乙烯
B. 氯甲醚
C. 甲醛
D. 己内酰胺
E. 联苯胺

正确答案：A。氯乙烯

解析：本题考查引发肝血管肉瘤的物质。肝血管肉瘤又称肝血管内皮瘤，是一种极其罕见又很难诊断的高度恶性肝肿瘤。多为先天性，常见于婴儿。职业性的肝血管肉瘤主要与接触氯乙烯（A对BCDE错）有关，多见于接触高浓度氯乙烯的清釜工，潜伏期长。